抢救危重患者工作的特殊性，不包括
A. 病情变化急骤，带有突发性
B. 病情严重，救治难度大
C. 病情复杂，工作量大
D. 家属焦躁情绪易发，易造成医患关系紧张
E. 情况变化多端，难以预测

正确答案：D。家属焦躁情绪易发，易造成医患关系紧张